一项研究得出某因素与疾病之间联系的OR为1.1，其95%可信区间为0.7～1.5，说明
A. 总体OR值95%的可能是错误的
B. 总体OR值在0.7～1.5区间内
C. 总体OR值说明该因素与疾病无关，而95%区间说明有联系
D. 存在偏倚的可能性为95%
E. 因素与疾病正负联系均存在

正确答案：B。总体OR值在0.7～1.5区间内

解析：本题考查比值比的应用。根据OR的可信区间是否包括1可推断暴露因素与疾病间有无关联。如果OR95%CI包括1，说明如果进行多次病例对照研究，可能有95%的研究其OR值等于1或接近1，即研究因素与研究疾病无关联。本题中OR为1.1，其95%可信区间为0.7～1.5，说明总体OR值在0.7～1.5的机会为95%（B对ACDE错）。